患者有高血压病史3年，无自觉症状。检查：血压160/95mmHg（21.3/12.6kPa），尿常规无异常，心电图及X线显示左心室肥大。应首先考虑的是
A. 恶性高血压
B. 高血压病一期
C. 高血压病二期
D. 高血压病三期
E. 高血压脑病

正确答案：C。高血压病二期

解析：本例患者有长期高血压病史，查体：血压160/95mmHg（正常值为90～139/60～89），提示2级高血压，尿常规无异常说明无明显肾功能损害，心电图及X线显示左心室肥大，故诊断应首先考虑的是高血压病二期（C对）。高血压二期是指高血压患者出现下列一项病变-左心室肥厚或劳损，视网膜动脉出现狭窄，蛋白尿或血肌酐水平升高。恶性高血压（A错）患者病情发展急骤，舒张压持续＞130mmHg，并伴有头痛、视力模糊、眼底出血和视盘水肿，肾脏损害突出。高血压病一期（B错）是指高血压患者临床上无脑、心、肾等重要器官损害的表现。高血压病三期（D错）是指高血压患者出现下列一项病变-左心衰竭、肾功能衰竭、脑血管意外、视网膜出血渗出，合并或不合并视乳头水肿。高血压脑病（E错）是指血压突然升高超过脑血管自动调节的阈值时，脑血流出现高灌注，毛细血管压力增高，渗透性增强，导致脑水肿和颅内压增高，甚至脑疝的形成，引起的一系列暂时性脑循环功能障碍的临床表现，其常见症状为头痛、呕吐、烦躁不安。